实施健康教育计划要从哪些方面控制
A. 社区卫生服务资源
B. 社区特定的家庭健康
C. 社区特定的个人健康
D. 社区特定的人群健康
E. 时间控制、质量控制、对象控制

正确答案：D。社区特定的人群健康